右心衰最有意义的表现
A. 颈静脉怒张
B. 双下肢水肿
C. 肝颈静脉回流征阳性
D. 肺动脉第二心音亢进
E. 三尖瓣区杂音

正确答案：C。肝颈静脉回流征阳性

解析：颈静脉搏动增强、充盈、怒张是右心衰时的主要体征，肝颈静脉反流征阳性则更具特征性（C对）。